蛔虫症患者，给予驱虫剂治疗
A. 病因学治疗
B. 发病学治疗
C. 两者均有
D. 两者均无
E. 无

正确答案：A。病因学治疗

解析：将病因分为外源性和内源性两大类，寄生虫属于生物因素，生物因素属于外源性病因（A对）。